女，42岁。近1个月出现进行性腰部疼痛，夜间加重。1年前因“乳腺癌”行手术治疗。为明确腰痛原因，最有价值的检查是
A. 骨密度
B. X线片
C. CT
D. 核素扫描
E. B超

正确答案：D。核素扫描

解析：中年女性，1年前行乳腺癌手术治疗，近期出现进行性腰部疼痛（患者有乳腺癌病史，近期腰部疼痛，考虑为乳腺癌的椎骨转移），为查明原因应首先除外是否有乳腺癌椎体转移，首选核素扫描（D对）。骨密度检查是检查骨的生理情况，对于明确腰痛的原因无意义（A错）。X线片可表现为溶骨性、成骨性和混合型的骨质破坏，但不是最敏感的检查方法（B错）。CT较X线检查相比可以避免气体对图像的影响，可以检查软组织受损情况，但相比核素扫描，仍然不精确（C错）。B超对于检查有无乳腺癌转移、明确腰痛原因意义不大（E错）。